易引起二重感染的主要原因是
A. 联合应用抗菌药物
B. 致病菌量过多
C. 使用免疫抑制剂
D. 营养不良
E. 全身免疫力降低

正确答案：A。联合应用抗菌药物

解析：不合理地使用抗菌药物不仅会引起毒副作用和过敏反应，还会增加病原菌的耐药性，导致二重感染（A对）。